接触患者血液口腔器械为
A. 高危器械
B. 中危器械
C. 低危器械
D. 超高危器械
E. 超低危器械

正确答案：A。高危器械

解析：高危器械指接触患者口腔伤口、血液、破损黏膜或进入口腔无菌组织、或穿破口腔软组织进入骨组织或牙齿内部的各类口腔器械；掌握“口腔器械的消毒与灭菌及医疗废物处理”知识点。